关于妊娠期生殖系统的变化，正确的是
A. 卵泡发育及排卵活跃，可见多个卵细胞形成
B. 子宫各部均匀增大
C. 子宫峡部在妊娠晚期开始变软并延长
D. 阴道皱襞增多并伸展性增加
E. 宫颈管内的腺体肥大增生并粘液减少

正确答案：D。阴道皱襞增多并伸展性增加

解析：妊娠期生殖系统的变化有：阴道壁皱襞增多，周围结缔组织变疏松，肌肉细胞肥大，伸展性增加，即阴道皱襞增多并伸展性增加（D对）。妊娠期卵巢排卵和新卵泡发育均停止（A错）。子宫各部增长速度：宫底于妊娠后期增长最快，宫体含肌纤维最多，子宫下段次之，宫颈最少，故子宫各部不是均匀增大（B错）。妊娠后子宫峡部开始变软，逐渐伸展拉长变薄，扩展成宫腔一部分，临产后伸展至7-10cm，成为产道一部分，称为子宫下段，不是在妊娠晚期开始变软并延长（C错）。宫颈管内腺体增生、肥大，使宫颈自妊娠早期逐渐变软，呈紫蓝色，妊娠期宫颈黏液增多，形成黏稠黏液栓，而不是宫颈管内的腺体肥大增生并粘液减少（E错）。